下列关于组牙功能（牙合）的特点中，不恰当的是
A. 是以成组的牙齿行使功能
B. 下颌前伸咬合时，上下前牙组切缘不接触后牙接触
C. 做侧方咬合时，工作侧上下后牙均匀接触
D. 可以分散（牙合）为，减轻个别牙的负担
E. 做侧方咬合时，非工作侧上下后牙不接触

正确答案：B。下颌前伸咬合时，上下前牙组切缘不接触后牙接触

解析：组牙功能（牙合）：是以成组的牙齿行使功能。正中关系（牙合）与正中（牙合）协调；下颌前伸咬合时，上下前牙组切缘接触后牙不接触；做侧方咬合时，工作侧上下后牙均匀接触，非工作侧上下后牙不接触。这种接触形式可以分散（牙合）为，减轻个别牙的负担，使牙及牙周免受创伤。掌握“（牙合）分类及临床意义与面部结构”知识点。